营血亏损常见的面部表现是
A. 淡白而消瘦
B. 暗黄而消瘦
C. 光白而虚浮
D. 青黑而虚浮
E. 暗红而消瘦

正确答案：A。淡白而消瘦

解析：本题考查的是白色的临床意义。营血亏损常见的面部表现是淡白而消瘦（A对）。白色的临床意义，白色主虚寒证、失血证。白为气血不荣之候，凡阳气虚衰，气血运行无力，或耗气失血，致使气血不充，颜面俱呈白色。若白而虚浮（C错），多属阳气不足；淡白而消瘦，多为营血亏损。若急性病突然面色苍白，常属阳气暴脱的证候。里寒证剧烈腹痛，或虚寒战栗时，也可见面色苍白，则为阴寒凝滞、经脉拘急所致。